主承托区可承受较大的咀嚼压力是因为
A. 面积大
B. 牙槽骨致密
C. 有坚韧的黏膜
D. 此处牙槽嵴宽
E. 以上均对

正确答案：C。有坚韧的黏膜

解析：主承托区：包括上下颌牙槽嵴顶的区域，以及除上颌硬区之外的硬腭水平部分。该区域表面通常为附着黏膜，有高度角化的复层鳞状上皮，黏膜下层致密，有一定的弹性，移动度小，能够抵抗义齿基托的压力，是承担义齿咀嚼压力的主要区域。义齿基托应与主承托区黏膜密合。当下颌牙槽嵴重度吸收时，牙槽嵴顶呈刃状或索条状，此时，下颌牙槽嵴顶就不能作为主承托区，而是需要在义齿基托相应部位加以缓冲，避免压痛。同时，下颌后部牙槽嵴颊侧的颊棚区趋于水平，由于其表面骨质致密，能承受较大的垂直向压力，可作为下颌义齿的主承托区。掌握“无牙颌的解剖标志及功能分区”知识点。